肾上腺素与受体结合后，细胞内发生什么变化
A. 核受体激活
B. cAMP升高
C. cGMP升高
D. 细胞内受体结合
E. IP3降解

正确答案：B。cAMP升高

解析：肾上腺素和去甲肾上腺素作用于靶细胞a受体和β受体后，分别通过 PLC-IP3/DG PKC和AC-cAMP-PKA 信号转导通路而发挥作用，cAMP升高（B对）。cGMP、IP3属于第二信使（CE错）。在细胞膜中的受体称为膜受体，在胞质内和核内的受体分别称为胞质受体和核受体（AD错）。